阿莫西林与克拉维酸联合使用
A. 产生协同作用，增强药效
B. 减少或延缓耐药性的发生
C. 形成可溶性复合物，有利于吸收
D. 改变尿液pH，有利于药物代谢
E. 利用药物间的拮抗作用，克服某些药物的毒副作用

正确答案：B。减少或延缓耐药性的发生

解析：本题考查药物的配伍变化。阿莫西林与克拉维酸配伍可提高疗效，延缓或减少耐药性（B对ACDE错）。